患儿，女，8岁，右上颌中切牙外伤冠折，切角缺损，即刻来院就诊。口腔检查发现：穿髓孔大，探痛明显，可疑叩痛。若治疗成功，家长要求修复缺损，则患牙牙冠应进行
A. 局麻备牙，全冠修复
B. 桩冠修复
C. 打固位钉，复合树脂充填
D. 切角嵌体
E. 解释病情，待患儿成年后再做修复

正确答案：C。打固位钉，复合树脂充填

解析：本题考查冠折的治疗。患儿，女，8岁，右上颌中切牙外伤冠折（年轻恒牙冠折），切角缺损（固位不够），即刻来院就诊。口腔检查发现：穿髓孔大，探痛明显，可疑叩痛（牙髓炎），则患牙牙冠应进行打固位钉，复合树脂充填（C对）。由于是年轻恒牙，根尖尚未发育完全，且位于前牙要考虑美观因素，应尽量保守治疗，让其牙根可以继续发育，尽量不做永久修复，故不选择局麻备牙，全冠修复（A错）、桩冠修复（B错）、切角嵌体（D错）。由于是家长要求修复缺损，且应该及时修复，故不应解释病情，待患儿成年后再做修复（E错）。